合并低钾血症的高血压患者降压不宜使用的药物是
A. 噻嗪类利尿剂
B. α受体阻滞剂
C. 血管紧张素转换酶抑制剂
D. 二氢吡啶类钙通道阻滞剂
E. β受体阻滞剂

正确答案：A。噻嗪类利尿剂

解析：噻嗪类利尿剂属于排钾利尿剂，长期使用会引起低血钾，因此，若高血压患者本身合并低钾血症，则不宜选用噻嗪类利尿剂（A错，本题正确答案），否则会进一步加重低血钾。用于抗高血压治疗的α受体阻滞剂（B对）主要为α₁受体阻滞剂，如哌唑嗪、特拉唑嗪等，因其副作用较多，目前不主张单独使用（P255）。血管紧张素转换酶抑制剂（P255）（C对）可以通过抑制循环和组织ACE，使ATⅡ生成减少，同时抑制激肽酶使缓激肽降解减少，起到降压作用。二氢吡啶类钙通道阻滞剂可以通过阻滞电压依赖L型钙通道减少细胞外钙离子进入血管平滑肌细胞内，减弱兴奋收缩偶联，降低阻力血管的收缩反应从而起到降压作用（D对）。β受体阻滞剂（E对）可通过抑制中枢和周围RAAS，抑制心肌收缩力和减慢心率发挥降压作用。后四种药物对血钾浓度均无明显影响，可用于合并低钾血症的高血压患者。